AMP和GMP在细胞内分解时，均首先转化成
A. 黄嘌呤
B. 内嘌呤
C. 次黄嘌呤核苷酸
D. 黄嘌呤核苷酸
E. 黄嘌呤核苷

正确答案：A。黄嘌呤